种子呈扁圆形，表面平滑，有光泽，一面较平坦，中央有一条隆起线纹，另一面稍突起的药材是
A. 薏苡仁
B. 桃仁
C. 砂仁
D. 苦杏仁
E. 酸枣仁

正确答案：E。酸枣仁

解析：本题考查的是酸枣仁药材的性状鉴别。种子呈扁圆形，表面平滑，有光泽，一面较平坦，中央有一条隆起线纹，另一面稍突起的药材是酸枣仁（E对）。酸枣仁：【性状鉴别】药材呈扁圆形或扁椭圆形。表面紫红色或紫褐色，平滑有光泽，有的有裂纹。有的两面均呈圆隆状突起；有的一面较平坦，中间有1条隆起的纵线纹，另一面微隆起，边缘略薄。一端凹陷，可见线形种脐，另一端有细小突起的合点。种皮较脆，胚乳白色，子叶2，浅黄色，富油性。气微，味淡。薏苡仁（A错）：【性状鉴别】药材呈宽卵形或长椭圆形。表面乳白色，光滑，偶有残存的黄褐色种皮。一端钝圆，另端较宽而微凹，有1淡棕色点状种脐；背面圆凸，腹面有1条较宽而深的纵沟。质坚实，断面白色，粉性。气微，味微甜。桃仁（B错）：【性状鉴别】药材桃仁呈扁长卵形。表面黄棕色至红棕色，密布颗粒状突起。一端尖，中部膨大，另端钝圆稍偏斜，边缘较薄。尖端一侧有短线形种脐，圆端有颜色略深不甚明显的合点，自合点处散出多数纵向维管束。种皮薄，子叶2，类白色，富油性。气微，味微苦。砂仁（C错）：【性状鉴别】药材阳春砂、绿壳砂呈椭圆形或卵圆形，有不明显的三棱。表面棕褐色，密生刺状突起，顶端有花被残基，基部常有果梗。果皮薄而软。种子集结成团，具三钝棱，中有白色隔膜，将种子团分成3瓣，每瓣有种子5～26粒。种子为不规则多面体；表面棕红色或暗褐色，有细皱纹，外被淡棕色膜质假种皮；质硬，断面胚乳灰白色。气芳香而浓烈，味辛凉、微苦。苦杏仁（D错）：【性状鉴别】药材呈扁心形。表面黄棕色至深棕色，一端尖，另端钝圆，肥厚，左右不对称，尖端一侧有短线形种脐，圆端合点处向上具多数深棕色的脉纹。种皮薄，子叶2，乳白色，富油性。气微，味苦。